亲脂性较强，易通过血脑屏障的药物是
A. 卡莫司汀
B. 氟尿嘧啶
C. 环磷酰胺
D. 巯嘌呤
E. 盐酸阿糖胞苷

正确答案：A。卡莫司汀